盐酸布桂嗪为镇痛药，临床用于
A. 偏头痛、三叉神经痛、外伤性疼痛及癌痛
B. 偏头痛、内脏平滑肌绞痛、外伤性疼痛及癌痛
C. 偏头痛、慢性荨麻疹
D. 各种疼痛及手术后镇痛，亦用作麻醉辅助药
E. 创伤痛、癌症剧痛、手术后镇痛

正确答案：A。偏头痛、三叉神经痛、外伤性疼痛及癌痛

解析：本题考查镇痛药的作用。盐酸布桂嗪为镇痛药，临床用于偏头痛、三叉神经痛、外伤性疼痛及癌痛（A对）；芬太尼适用于各种疼痛及外科、妇科等手术后和手术过程中的镇痛；还可与麻醉药合用，作为麻醉辅助用药（D错）；美沙酮用于创伤、手术后、晚期癌症等引起的剧痛（E错）。